患者，女，55岁。患高血压已6年余，现症见：头晕胀痛，耳鸣，夜寐不安，多梦，腰膝酸软，舌红苔少，其脉象可表现为
A. 弦滑数
B. 弦细数
C. 细数
D. 弦数
E. 滑数

正确答案：B。弦细数

解析：根据题干可知，患者既有头晕胀痛，夜寐不安，多梦等肝郁化火之症，又有舌红苔少、耳鸣、腰膝酸软等阴虚之症；故其脉象为弦细脉（B对）。